以热治热的治法适用于
A. 瘀血所致崩漏者
B. 阴寒内盛，格阳于外而见热象者
C. 里热盛极，阳盛格阴而见寒象者
D. 因脾虚而致痞满且大便不畅者
E. 因实热壅积而致大便不通者

正确答案：B。阴寒内盛，格阳于外而见热象者

解析：阴寒内盛，格阳于外而见热象者，属于内真寒而外假热，需要用热性药来治疗，属于以热治热（B对）。由于瘀血内阻，血不循经所致的崩漏（A错），当活血化瘀，瘀去则血自归经而出血自止，属于通因通用。里热盛极，阳盛格阴而见寒象者（C错），属于阳盛格阴，需要用寒性药物来治疗，属于以寒治寒。因脾虚而致痞满且大便不畅者（D错），是因脾虚无力运化所致，当采用补脾益气的方药，属塞因塞用。因实热壅积而致大便不通者（E错），为有形实邪郁滞，应当实则泻之。